某男，28岁。突然发热，高热不退，周身酸痛，咽喉疼痛，舌红，苔黄，脉浮数。自诉有多位同事出现类似症状。中医诊断是
A. 风寒感冒
B. 风热感冒
C. 暑湿感冒
D. 体虚感冒
E. 时行感冒

正确答案：E。时行感冒

解析：本题考查的是感冒的辨证论治。突然发热，高热不退，周身酸痛，咽喉疼痛，舌红，苔黄，脉浮数。自诉有多位同事出现类似症状。中医诊断是时行感冒（E对）。感冒是感受风邪或时行病毒，卫表失和而导致的常见外感疾病，临床表现以鼻塞、流涕、喷嚏、头痛、恶寒、发热、全身不适、脉浮等为特征。西医学中普通感冒（伤风）、流行性感冒（时行感冒）及其他上呼吸道感染，有上述临床表现者可参考此内容辨证论治。（一）风寒感冒（A错）：【症状】恶寒重，发热轻，无汗头痛，肢体酸痛，或鼻塞声重，或鼻痒喷嚏，流涕清稀，咽痒，咳嗽，咳痰稀白。舌苔薄白，脉浮紧。（二）风热感冒（B错）：【症状】身热较著，微恶风，头胀痛，或咳嗽少痰，或痰出不爽，咽痛咽红，口渴。舌边尖红，苔薄白或微黄，脉浮数。（三）时行感冒：【症状】突然发热，高热不退，甚则寒战，周身酸痛，无汗，咳嗽，口干，咽喉疼痛，伴明显全身症状，呈现流行性发作。舌红，苔黄，脉浮数。（四）气虚感冒（D错）：【症状】发热，恶寒较甚，无汗，头痛鼻塞，身楚倦怠，咳嗽，痰白，咳痰无力。舌淡，苔白，脉浮而无力。暑湿感冒（C错）的症状，2022年考试指南未明确说明。